1型观测线适用于什么卡环
A. 圆形卡环
B. 杆形卡环
C. 倒钩卡环
D. 高臂卡环
E. 隙卡

正确答案：A。圆形卡环

解析：本题考查卡环的种类。Ⅰ型观测线适用于圆形卡环（A对）。Ⅰ型导线卡环：一般为圆环形卡环，卡环臂在倒凹区，卡环体在非倒凹区，此类卡环的固位作用及卡抱稳定作用良好。Ⅱ型导线卡环：多为铸造杆形卡环（B错），杆形卡环的近缺牙区臂端在倒凹区，卡环臂其余部分在非倒凹区，起对抗平衡作用。此类卡环有一定的固位作用，但因无卡环体，故稳定作用较差。Ⅲ型导线卡环：为靠近（牙合）缘的高臂卡环（D错），卡环臂端在倒凹区。此类卡环有一定的卡抱和稳定固位作用，但不如Ⅰ型导线卡环理想。要求卡环臂富有弹性，能通过基牙较高的突点进入倒凹。倒钩卡环（C错）常用于倒凹区在支托的同侧下方的Ⅱ型观测线基牙。隙卡（E错）是用于非缺隙侧单个基牙上的三臂卡环。由颊、舌臂和位于（牙合）边缘嵴处的（牙合）支托组成，卡环体位于基牙及其邻牙间的（牙合）外展隙，通过位于舌侧外展隙的小连接体与义齿支架的大连接体相连。